药品的每个最小销售单元的包装
A. 必须按照规定印有或贴有标签并附有说明书
B. 分为大包装和中包装
C. 必须印有商标
D. 指直接与药品接触的包装
E. 必须注明不良反应

正确答案：A。必须按照规定印有或贴有标签并附有说明书

解析：本题考查药品说明书。药品的每个最小销售单元的包装必须按照规定印有或贴有标签并附有说明书（A对）。药品说明书由药品生产企业依照国家规定的格式要求，以及批准的内容编写，上市销售药品的最小包装中应附有药品说明书。